主要由导管内衬上皮细胞和变异肌上皮细胞构成，根据细胞类型和排列方式分为筛状型、管状型、和实性型三种类型的涎腺恶性肿瘤是
A. 恶性多形性腺瘤
B. 腺泡细胞癌
C. 黏液表皮样癌
D. 腺样囊性癌
E. 多形性低度恶性腺癌

正确答案：D。腺样囊性癌

解析：本题考查腺样囊性癌的病理变化。主要由导管内衬上皮细胞和变异肌上皮细胞构成，根据细胞类型和排列方式分为筛状型、管状型、和实性型三种类型的涎腺恶性肿瘤是腺样囊性癌（D对）。腺样囊性癌在光镜下，肿瘤实质细胞主要为导管内衬上皮细胞和变异肌上皮细胞，根据肿瘤细胞类型和排列方式分为三种组织类型：筛状型、管状型和实性型。